六味地黄丸组成中含有的药物是
A. 泽泻，丹参
B. 茯苓，牡丹皮
C. 阿胶，白术
D. 滑石，山药
E. 茯苓，滑石

正确答案：B。茯苓，牡丹皮

解析：本题考查六味地黄丸的组成，记忆即可。六味地黄丸由熟地黄、山茱萸、山药、泽泻、牡丹皮、茯苓（B对）组成，具有滋补肝肾的功效。趣记：八（熟地黄）山山，茯泽丹皮。